只能凭专用处方在本医疗机构使用的是
A. 医疗机构配制的制剂
B. 处方药
C. 甲类非处方药
D. 保健食品
E. 麻醉药品

正确答案：E。麻醉药品

解析：本题考查麻醉药品和第一类精神药品的处方资格及处方管理。只能凭专用处方在本医疗机构使用的是麻醉药品（E对）。执业医师应当使用专用处方开具麻醉药品和精神药品，单张处方的最大用量应当符合国务院卫生主管部门的规定。对麻醉药品和第一类精神药品处方，处方的调配人、核对人应当仔细核对，签署姓名，并予以登记；对不符合处方管理规定的，处方的调配人、核对人应当拒绝发药。医疗机构制剂（A错）凭执业医师或者执业助理医师的处方在本单位内部使用，并与《医疗机构执业许可证》所载明的诊疗范围一致。处方药（B错）必须凭执业医师或执业助理医师处方才可调配、购买和使用；非处方药（C错）不需要凭执业医师或执业助理医师处方即可自行判断、购买和使用。保健食品（D错）的使用无需处方。